用于胃食管反流病诊断性治疗的药物是
A. 多潘立酮
B. 枸橼酸铋钾
C. 奥美拉唑
D. 铝碳酸镁
E. 雷尼替丁

正确答案：C。奥美拉唑

解析：质子泵抑制剂（PPI）如奥美拉唑（C对）通过非竞争性不可逆的对抗作用，抑制胃壁细胞内的质子泵，其抑酸作用强且持久，用于胃食管反流病的诊断性治疗。多潘立酮（A错）属于促胃肠动力药；枸橼酸铋钾（B错）、铝碳酸镁（D错）属于胃黏膜保护药；雷尼替丁（E错）属于H₂受体拮抗剂，一般均不用于胃食管反流病的诊断性治疗。